乳突窦
A. 是鼓室与乳突小房间的小腔
B. 向前开口于鼓室
C. 向后与乳突小房相连通
D. 以上均对
E. 无

正确答案：D。以上均对

解析：乳突窦位于鼓室上隐窝的后方，向前开口于鼓室（B对），向后与乳突小房相连通（C对），为鼓室和乳突小房之间的小腔（A对，故D为本题正确答案）。